青霉素G对下列哪种细菌基本无效
A. 破伤风梭菌
B. 脑膜炎奈瑟菌
C. 梅毒螺旋体
D. 溶血性链球菌
E. 变形杆菌

正确答案：E。变形杆菌